男，60岁。进行性消瘦，低热，食欲不振，伴右上腹胀痛三个月。查体，皮肤粘膜无黄染，浅表淋巴结无肿大，心肺检查无异常，肝肋下1.5厘米，剑突下4厘米可及。白细胞4×10⁹/L。B超显示右叶有直径5厘米的强回声团块，中央可见液性暗区。正确的诊断是
A. 肝硬化
B. 肝癌
C. 肝囊肿
D. 肝结核
E. 肝脓肿

正确答案：B。肝癌

解析：中老年男性患者，进行性消瘦，低热，食欲不振，伴右上腹胀痛三个月（肝癌常见临床表现）。肝肋下1.5厘米，剑突下4厘米可及（肝癌常有肝大）。B超显示右叶有直径5厘米的强回声团块，中央可见液性暗区（B超可显示肝癌形态），综合病人症状、体征、影像学检查可诊断为肝癌（B对）。肝硬化（九版内科学P410）（A错）临床诊断通常依据肝功能减退和门静脉高压同时存在的证据如蜘蛛痣、肝掌；脾大、交通支扩张等。肝囊肿（P421）（C错）虽然可以出现液性暗区，但不会出现B超强回声光团以及进行性消瘦、低热等消耗性症状。肝结核（D错）多数为全身粟粒性结核的一部分，患者主要表现为肺、肠等结核引起的临床表现，一般不出现肝病的临床症状，抗结核治疗有效，临床上很难作出肝结核的诊断。肝脓肿（P414）（E错）较急，主要症状是寒战、高热、肝区疼痛和肿大，体温常可高达39～40℃，不会出现B超强回声光团以及进行性消瘦。